学校完全禁止吸烟、禁止喝酒属于
A. 学校健康教育
B. 学校卫生服务
C. 学校健康政策
D. 学校事物环境
E. 学校健康物质环境

正确答案：C。学校健康政策